初孕妇，24岁。妊娠38周，自觉头痛，视物不清4天。下列情况与疾病严重程度关系较小的是
A. 血压水平
B. 水肿程度
C. 眼底检查
D. 自觉症状
E. 尿蛋白

正确答案：B。水肿程度

解析：该患者妊娠38周，自觉头痛，视物不清4天（重度子痫前期可有持续头痛或视觉障碍或其它脑神经症状），应首先考虑为妊娠期高血压疾病。按严重程度，妊娠期高血压疾病分为4类：①妊娠期高血压：BP≥140/90mmHg，尿蛋白（﹣），少数可伴有上腹部不适；②子痫前期：BP≥140/90mmHg，伴尿蛋白≥0.3g/24h，或随机尿蛋白（+），或虽无蛋白尿，但合并下列任何一项者：血小板减少；肝功能损害；肾功能损害；肺水肿；新发生的中枢神经系统异常或视觉障碍。③子痫：是在子痫前期的基础上发生了不能用其他原因解释的抽搐。通过眼底检查可以直接观察到视网膜小动脉的痉挛程度，是子痫前期-子痫严重程度的重要参考指标。故血压水平（A对）、眼底检查（C对）、自觉症状（D对）、尿蛋白（E对）与妊娠期高血压疾病严重程度密切相关。水肿程度（B错，为本题的正确答案）在妊娠期高血压疾病标准中未涉及，与疾病严重程度关系较小。